男，38岁。乏力，食欲差，左上腹胀痛1个月。查体：肝肋下3cm，脾肋下10cm。血红蛋白120g/L，白细胞260x10⁹/L，血小板210x10⁹/L，白细胞分类：中幼粒及晚幼粒细胞为主，中性粒细胞碱性磷酸酶活性减低。首选的治疗是
A. 酪氨酸激酶抑制剂（TKI）
B. 第三代头孢菌素
C. 脾切除
D. DA方案
E. 保肝治疗

正确答案：A。酪氨酸激酶抑制剂（TKI）